龈增生的病理变化主要是
A. 牙龈上皮增生
B. 牙龈纤维结缔组织增生
C. 牙龈血管增生
D. 牙龈纤维水肿
E. 牙龈纤维瘢痕化

正确答案：B。牙龈纤维结缔组织增生

解析：龈增生主要指由多种原因引发的以纤维结缔组织增生为主要病理改变的一组疾病，又称增生性龈炎。主要由全身性因素引起（包括月经期、青春期、妊娠性及苯妥英钠药物性龈炎），常常合并有局部菌斑感染，而呈现为炎症性的增生。龈增生其主要组织病理学变化为纤维结缔组织增生，粗大的胶原纤维束类似瘢痕组织结构；还可出现胶原纤维水肿、变性及毛细血管增生、扩张、充血等变化。一般炎症不明显。上述龈增生合并口腔菌斑感染时，则与慢性龈炎并存，其病理学变化也出现炎症反应的一系列改变。掌握“牙龈疾病”知识点。